能破血逐瘀的是
A. 丹参
B. 红花
C. 水蛭
D. 乳香
E. 五灵脂

正确答案：C。水蛭

解析：本题考查的是水蛭的功效。能破血逐瘀的是水蛭（C对）。水蛭：【功效】破血逐瘀，通经。丹参（A错）：【功效】活血祛瘀，通经止痛，清心除烦，凉血消痈。红花（B错）：【功效】活血通经，祛瘀止痛。乳香（D错）：【功效】活血止痛，消肿生肌。五灵脂（E错）：【功效】活血止痛，化瘀止血，解蛇虫毒。